某女，49岁。近半年经常寐中汗出，醒后汗止，时有自汗，口渴咽干，五心烦热，两颧色红；舌红少苔，脉细数。宜选用的基础方剂是
A. 当归六黄汤
B. 归脾汤
C. 玉屏风散
D. 逍遥散
E. 龙胆泻肝汤

正确答案：A。当归六黄汤

解析：本题考查的是汗证的辨证论治。某女，49岁。近半年经常寐中汗出，醒后汗止，时有自汗，口渴咽干，五心烦热，两颧色红；舌红少苔，脉细数。宜选用的基础方剂是当归六黄汤（A对）。汗证是以汗液外泄失常为主症的疾病。不因外界环境因素的影响，白昼时时汗出，动辄益甚者称为自汗；寐中汗出，醒来即止者称为盗汗。西医学的甲状腺功能亢进、自主神经功能紊乱、风湿热、低血糖、虚脱、休克及结核病、肝病、黄疸等所致的以自汗、盗汗为主要表现者，可参考此内容辨证论治。（一）肺卫不固证：【症状】汗出恶风，稍劳尤甚，易于感冒，体倦乏力，面色少华。舌苔薄白，脉细弱。【方剂应用】基础方剂为玉屏风散（黄芪、白术、防风）加减（C错）。（二）心血不足证：【症状】睡则汗出，醒则自止，心悸怔忡，失眠多梦，神疲气短，面色少华。舌质淡，舌苔白，脉细。【方剂应用】基础方剂为归脾汤（人参、黄芪、白术、茯神、当归、龙眼肉、酸枣仁、远志、木香、甘草、生姜、大枣）加减（B错）。（三）阴虚火旺证：【症状】夜寐盗汗，或有自汗，五心烦热，或兼午后潮热，两颧色红，口渴。舌红少苔，脉细数。【方剂应用】基础方剂为当归六黄汤（当归、生地黄、熟地黄、黄连、黄芩、黄柏、黄芪）加减。（四）邪热郁蒸证：【症状】蒸蒸汗出，汗黏，易使衣服黄染，面赤烘热，烦躁，口苦，小便色黄。舌苔薄黄，脉弦。【方剂应用】基础方剂为龙胆泻肝汤（龙胆、黄芩、栀子、泽泻、木通、车前子、当归、生地、柴胡、甘草）加（E错）减。积聚肝气郁结证：【症状】腹中结块柔软，时聚时散，攻窜胀痛，脘胁胀闷不适。舌淡红，苔薄，脉弦。【方剂应用】基础方剂为逍遥散（柴胡、白术、白芍、当归、茯苓、甘草、薄荷、煨姜）合木香顺气散（木香、香附、槟榔、青皮、陈皮、厚朴、苍术、枳壳、砂仁、生姜、甘草）加减（D错）。